金黄色葡萄球菌产生
A. 内毒素
B. 肠毒素
C. 神经毒素
D. 细胞毒素
E. 红疹毒素

正确答案：B。肠毒素